氢氯噻嗪所致的主要不良反应
A. 血尿酸升高
B. 支气管痉挛
C. 血钠升高
D. 外周血肿
E. 血钾升高

正确答案：A。血尿酸升高

解析：本题考查药物的不良反应。氢氯噻嗪所致的主要不良反应是血尿酸升高（A对）。氢氯噻嗪为噻嗪类利尿药，可引起高尿酸血症，痛风患者慎用。支气管痉挛（B错）是β受体阻断剂的不良反应。血钾升高（E错）是保钾利尿药的不良反应。